男，16岁。腹痛、腹泻、消瘦3年。腹部阵发性疼痛，大便3～4次/日，伴黏液和血。有家族性结肠息肉病史。查体：营养不良，贫血貌，腹平软，下腹部有轻压痛。结肠镜检查见结肠内全部布满息肉，直肠病变轻。最佳手术方式是
A. 单腔回肠造瘘术
B. 结肠次全切除术
C. 全结肠切除、末端回肠直肠吻合术
D. 电灼摘除息肉
E. 经腹会阴联合全结直肠切除术

正确答案：C。全结肠切除、末端回肠直肠吻合术

解析：青春期男孩，全结肠布满息肉，有家族史，应考虑家族性肠息肉病。该病癌变率几乎100%，确诊之后即行手术治疗，最佳手术方式是全结肠切除、末端回肠直肠吻合术（C对）。单纯回肠造瘘术未切除结肠息肉，将导致癌变（A错）。结肠次全切除术可遗留部分结肠息肉，也会导致癌变（B错）。患者全结肠布满息肉，不可能依靠电灼将息肉一一分次摘除（D错）。患者未癌变，不需切除直肠，排除经腹会阴联合全结直肠切除术（E错）。